男性，55岁。双下肢无力半年，右侧明显，近2个月行走不稳，右手不能扣纽扣。无外伤史，无发热。体格检查，颈背部无明显压痛，两上肢前臂、手及上臂尺侧皮肤感觉减退，右侧尤其明显，四肢肌张力增高。肱二头肌反射亢进，双侧膝踝反射亢进，右髌阵挛阳性，右侧巴彬斯基征阳性。最有助于鉴别诊断的辅助检查为
A. 颈椎X线片
B. 颈段X线断层摄片
C. 肌电图
D. 颈段MRI
E. 核素扫描

正确答案：D。颈段MRI

解析：中年男性（颈椎病的好发年龄），双下肢无力半年，右侧明显，近2个月行走不稳，右手不能扣纽扣（提示四肢运动障碍，双手精细动作障碍）。体格检查：两上肢前臂、手及上臂尺侧皮肤感觉减退（上肢感觉障碍），右侧尤其明显，四肢肌张力增高。肱二头肌反射亢进（提示颈髓5～6节受压），双侧膝踝反射亢进，右髌阵挛阳性，右侧巴彬斯基征阳性（病理征阳性）。综合该患者的临床症状、体征考虑该患者最可能的诊断为颈椎病（脊髓型）。MRI检查T1WI示椎间盘向椎管内突出等，T2WI示硬膜外腔消失，椎间盘呈低信号，脊髓受压或脊髓内出现高信号区，其敏感性及特异性明显高于颈段X线断层摄片（D对B错）。X线检查主要用以排除其他病变（A错）。肌电图用于评估肌肉、神经肌肉接头、周围神经和控制肌肉神经细胞是否正常，可用来评估肌力，但诊断主要靠影像学的检查（C错）。核素扫描不用于颈椎病的诊断，主要用于骨、心肌、肾等器官代谢的检查（E错）。